下列各项中不属于“八法”内容的是
A. 清法、补法
B. 和法、温法
C. 汗法、吐法
D. 下法、清法
E. 消法、通法

正确答案：E。消法、通法

解析：本题考查八法的内容，属记忆内容。八法有汗、和、下、消、吐、清、温、补八法没有通法（E错，为本题正确答案）。